如果一个修复体造成了牙龈炎症和牙周破坏，说明这个修复体可能存在的问题是
A. 邻面出现悬突
B. 龈缘的位置不佳，密合程度差
C. 表面粗糙，光洁度差
D. 凸度过大，接触不良或未恢复接触点
E. 以上均可能是其问题之一

正确答案：E。以上均可能是其问题之一

解析：本题考查修复体造成牙龈炎症和牙周破坏的原因。修复体的设计与牙周病密切相关。邻面出现悬突（A对），称为菌斑聚集和细菌增殖的场所，造成菌斑量的增加，菌斑成分改变，使得健康菌群转变为牙周致病菌群，还能刺激牙间乳头引起炎症，甚至牙槽骨吸收。龈缘的位置不佳，密合程度差（B对）也是牙周炎的局部促进因素。龈下边缘会增加菌斑量，甚至可能影响牙周附着，破坏生物学宽度，导致牙周炎症，牙槽骨吸收。密合度差的修复体边缘也成为菌斑的聚集场所。表面粗糙，光洁度差（C对）会增加菌斑附着表面积，增加菌斑量，加重牙龈炎症以及龈沟液的渗出。凸度过大，接触不良或未恢复接触点（D对）易造成凸处与龈缘之间的牙面上菌斑堆积或在不恰当的接触点处形成食物嵌塞，引发牙周疾病。（ABCD均对，故E为本题的正确答案）。